足少阴肾经起于
A. 至阴
B. 涌泉
C. 大敦
D. 太溪
E. 俞府

正确答案：B。涌泉

解析：足少阴肾经起于其井穴涌泉，在足底，屈足卷趾时足心最凹陷中；当足底第2、3趾蹼缘与足跟连线的前1/3与后2/3交点凹陷中（B对）。